失血量达到多少时，应立即输血
A. 300mL
B. 300mL～500mL
C. 500mL～800mL
D. 800mL～1000mL
E. 1000mL

正确答案：E。1000mL

解析：凡一次失血量低于总血容量的10%（500mL）者，机体可通过自身组织间液向血液循环转移而得到代偿，临床上常无血容量不足的表现，故无须输血。当失血量达总血容量的10%～20%（500～1000mL）时，应根据有无血容量不足的临床症状及其严重程度，同时参照血红蛋白和血细胞比容（HCT）的变化选择治疗方案，所以失血量在1000mL时，应立即输血（E对）。